大脑中动脉血栓形成的“三偏”征的表现是
A. 偏瘫、偏身感觉障碍、同向偏视
B. 偏瘫、偏盲、偏身感觉障碍
C. 偏盲、偏身感觉障碍、同侧偏瘫
D. 对侧偏瘫、偏身感觉障碍、同向偏盲
E. 交叉性偏瘫、偏视、偏身感觉障碍

正确答案：D。对侧偏瘫、偏身感觉障碍、同向偏盲

解析：大脑中动脉血栓形成的“三偏”征的表现是对侧偏瘫、偏身感觉障碍、同向偏盲（D对）。